用于治疗流感嗜血杆菌引起的脑膜炎的药物是
A. 氯霉素
B. 青霉素
C. 替莫西林
D. 四环素
E. 利福平

正确答案：A。氯霉素

解析：本题考查氯霉素。用于治疗流感嗜血杆菌引起的脑膜炎的药物是氯霉素（A对）。青霉素（B错）适用于革兰阳性球菌所致的感染以及破伤风、气性坏疽、流行性脑脊髓膜炎、鼠咬热、梅毒、淋病。替莫西林（C错）对革兰阴性菌有高度抗菌活性，对β-内酰胺酶高度稳定，某些第三代头孢菌素耐药的革兰阴性菌应用本品有效。四环素（D错）高浓度时具杀菌作用，除了常见的革兰氏阳性菌、革兰氏阴性菌以及厌氧菌外，多数立克次体属、支原体属、衣原体属、非典型分枝杆菌属、螺旋体也对该品敏感。利福平（E错）对结核分枝杆菌和部分非结核分枝杆菌（包括麻风分枝杆菌等）在宿主细胞内外均有明显的杀菌作用。